关于食品安全标准的说法错误的是
A. 食品安全国家标准应当经全国人民代表大会审查通过
B. 食品安全标准是强制执行的标准
C. 食品安全标准应当供公众免费查阅
D. 食品安全国家标准由国务院卫生行政部门会同国务院食品药品监督管理制定、公布
E. 国务院标准化行政部门提供国家标准编号

正确答案：A。食品安全国家标准应当经全国人民代表大会审查通过